以下是关于工业区与居住区配置的不同说法，哪项错误
A. 工业区应位于该地区常年主导风向的下风向
B. 工业区应位于生活饮用水源的下游
C. 工业区与居住区要设置一定宽度的卫生防护带
D. 对严重污染的工厂，应设在远郊
E. 工业区面积应宽阔，交通方便

正确答案：E。工业区面积应宽阔，交通方便

解析：本题考查工业区与居住区的配置。工业用地应按当地主导风向配置在生活居住用地的下风侧（A对）、河流的下游（B对）。工业用地与生活居住用地之间应保持适当距离，中间配置绿化防护带（C对）。占地面积大、污染严重的工业，应设在远郊（D对），加上配套的居住区和生活服务设施，形成相对独立的卫星城镇。消耗能源多、污染严重、运输量大的工业，应设在远郊；污染较轻、运输量中等的工业，可布置在城市边缘；污染轻微或无污染及运输量不大的工业，可设在居住区内的独立地段，用城市道路或绿化与住宅建筑群隔开（E错，为本题正确答案）。